股骨头的主要血液供应来源是
A. 旋股内外侧动脉的分支
B. 股圆韧带内的小凹动脉
C. 股骨干的滋养动脉升支
D. 闭孔动脉
E. 阴部内外动脉

正确答案：A。旋股内外侧动脉的分支

解析：股骨头血液供应来源有小凹动脉、股骨干滋养动脉升支和旋股内、外侧动脉。旋股内侧动脉又可分为骺外侧动脉、干骺端上侧动脉、干骺端下侧动脉，其中骺外侧动脉供应股骨头2/3～4/5区域的血液循环，是股骨头最主要的供血来源（A对BC错）。闭孔动脉（D错）的髋关节支发一小支进入股圆韧带为小凹动脉，提供股骨头凹部的血液循环，但是量少不是最主要的。阴部内外动脉（E错）的血液不供应股骨头。